腹部闭合性损伤时，最常受到损伤的空腔脏器是
A. 乙状结肠
B. 胃
C. 十二指肠
D. 升结肠
E. 小肠

正确答案：E。小肠

解析：腹部损伤分为开放性损伤和闭合性损伤。常见受损内脏在开放性损伤中依次是肝、小肠、胃、结肠、大血管等；在闭合性损伤中依次是脾、肾、小肠、肝、肠系膜等。故最常受到损伤的空腔脏器是小肠（E对），乙状结肠（A错）、胃（B错）、十二指肠（C错）、升结肠（D错）是开放性损伤常见受损内脏。(1)开放性损伤：依次是肝、小肠、胃、结肠、大血管等； 其中，①最易受损失的脏器是肝，②最易受损伤的空腔脏器是小肠。 (2)闭合性损伤：依次是脾、肾、小肠、肝、肠系膜等； 其中，①最易受损失的脏器是脾，②最易受损伤的空腔脏器是小肠。